为取代苯甲酸衍生物，分子中含有一个手性碳，S-异构体的活性大于R-异构体，在体内代谢迅速，作为餐时血糖调节剂的降血糖药物是
A. 米格列奈
B. 那格列奈
C. 盐酸吡格列酮
D. 瑞格列奈
E. 格列吡嗪

正确答案：D。瑞格列奈

解析：本题考查瑞格列奈。瑞格列奈（D对）是氨甲酰甲基苯甲酸的衍生物，分子中含有一个手性碳，（+）-S-构型的活性是（-）-R-构型的100倍，降糖快，作用时间短，可作为餐时血糖调节剂。那格列奈（B错）是D-苯丙氨酸衍生物。米格列奈（A错）与那格列奈结构相似。吡格列酮（C错）是噻唑烷二酮类药物。格列吡嗪（E错）是磺酰脲类药物